男，32岁。反复脓血便伴里急后重1年，抗生素治疗无效。下消化道X线钡剂造影检查发现直肠、乙状结肠多发龛影，黏膜粗乱及颗粒样改变。最可能的诊断是
A. 克罗恩病
B. 溃疡性结肠炎
C. 肠结核
D. 细菌性痢疾
E. 结肠癌

正确答案：B。溃疡性结肠炎

解析：中青年男性患者，反复脓血便伴里急后重（溃疡性结肠炎的典型表现）1年，抗生素治疗无效（与细菌性痢疾鉴别）。下消化道X线钡剂造影：直肠、乙状结肠（溃疡性结肠炎的好发部位）多发龛影，黏膜租乱及颗粒样改变（溃疡性结肠炎的主要X线征）。综合该患者的病史、钡剂灌肠检查，考虑诊断为溃疡性结肠炎（B对）。克罗恩病（P377）（A错）好发于回肠末段，临床以腹痛、腹泻、体重下降、腹块、瘘管形成和肠梗阻为特点，钡剂灌肠可见肠黏膜皱襞粗乱、纵行性溃疡或裂沟、鹅卵石征等征象。肠结核（P368）（C错）分为溃疡型肠结核和增生型肠结核，溃疡型肠结核常伴腹泻，多无脓血，钡剂灌肠检查示回盲部黏膜粗乱，充盈不佳，呈“跳跃征”；增生型肠结核以便秘为主，钡剂灌肠检查示肠腔变窄、肠段缩短变形、回肠和盲肠的正常角度消失。细菌性痢疾（D错）可有黏液脓血便，但抗生素治疗有效。结肠癌（P382）（E错）多发于老年患者，排便习惯与粪便性状改变常为本病最早出现的症状，钡剂灌肠可发现充盈缺损、肠腔狭窄、黏膜皱襞破坏等征象，显示癌肿部位和范围。